有关胸内压的叙述，错误的是
A. 一般情况下是负压
B. 胸内压=肺内压﹣肺回缩力
C. 胸内负压有利于静脉回流
D. 使肺维持一定的扩张程度
E. 产生气胸时负压增大

正确答案：E。产生气胸时负压增大